患者，女，18岁。易感疲乏，月经量多半年。面色苍白，皮肤可见散在出血点。检查：肝、脾肋缘下未触及，血红蛋白86g/L，白细胞2.8×10⁹/L，血小板4.5×10⁹/L。骨髓增生低下，未见巨核细胞。其诊断是
A. 缺铁性贫血
B. 急性白血病
C. 脾功能亢进
D. 再生障碍性贫血
E. 溶血性贫血

正确答案：D。再生障碍性贫血

解析：再生障碍性贫血（D对）主要表现为骨髓增生低下，三系细胞减少。本例患者血红蛋白、白细胞、血小板均低于正常值，且骨髓涂片提示骨髓增生低下，未见巨核细胞，伴有出血的症状，肝、脾肋缘下未触及，提示为再生障碍性贫血。缺铁性贫血（A错）表现为小细胞低色素性贫血及由于缺铁导致的其他异常，其诊断需依靠血清铁、骨髓铁染色等指标确诊。急性白血病（B错）骨髓象增生活跃，骨髓中异常的原始细胞及幼稚细胞（白血病细胞）大量增殖并抑制正常造血，可广泛浸润肝、脾、淋巴结等各种脏器。脾功能亢进（C错）临床表现为脾脏肿大，一种或多种血细胞减少而骨髓造血细胞相应增生，脾切除后血象可基本恢复，症状缓解。本例患者查体肝、脾肋缘下未触及，故排除。溶血性贫血（E错）时骨髓红系代偿性增生，因此骨髓涂片检查显示骨髓增生活跃，红系比例增高，与本例患者骨髓涂片不符。